慢性心力衰竭时推荐使用的β-受体阻断剂是
A. 所有已上市的β-受体阻断剂
B. 美托洛尔
C. 阿替洛尔
D. 普萘洛尔
E. 吲哚洛尔

正确答案：B。美托洛尔

解析：卡维地洛、比索洛尔和美托洛尔（B对）前已被推荐作为治疗慢性心力衰竭的常规用药。（中国心力衰竭诊断与治疗指南2014）由于长期持续性交感神经系统的过度激活和刺激，慢性心力衰竭患者的心肌β1受体下调和功能受损，β受体阻滞剂可恢复β1受体功能，推荐用琥珀酸美托洛尔、比索洛尔或卡维地洛，均能改善患者预后。